患者女性，63岁。慢性咳喘病史30余年，1年来出现双下肢浮肿，l周来咳喘加重，查体：发绀明显，桶状胸，剑突下可见心尖搏动，心率119次/分，律齐，双肺可闻及干湿性啰音，肝肋下1cm，双下肢浮肿（﹢），血常规：白细胞12×10⁹/L，胸片显示：肺气肿，右心室增大，肺纹理增重。首选的治疗措施是
A. 立即给予利尿剂，强心剂控制心力衰竭
B. 营养支持疗法
C. 立即给氧，应用呼吸兴奋剂等
D. 立即给予糖皮质激素和解痉平喘药物
E. 积极控制呼吸道感染，保持呼吸道通畅

正确答案：E。积极控制呼吸道感染，保持呼吸道通畅

解析：肺源性心脏病在急性加重期首先要控制感染，保持呼吸道的通常（E对），其次是利用强心药利尿药控制心力衰竭（A错），并给予氧疗纠正缺氧和二氧化碳潴留（C错）。肺心病患者因右心衰竭和高碳酸血症常导致胃肠道淤血、低氧血症，抗生素、茶碱对胃黏膜的刺激，又可导致胃肠功能紊乱和损伤，因此肺心病患者多有营养不良和呼吸肌疲劳，为了使呼吸衰竭能得到满意控制，营养支持疗法十分重要但不是首选措施（B错）。在有效控制感染的情况下，短期大剂量应用肾上腺皮质激素，对抢救早期呼吸衰竭和心力衰竭有一定作用（D错）。